用抗TNF单抗治疗类风湿关节炎为
A. 应用生物应答调节剂进行免疫治疗
B. 应用细胞因子拮抗剂的治疗
C. 应用细胞因子的治疗
D. 过继免疫治疗
E. 应用抗体进行免疫治疗

正确答案：B。应用细胞因子拮抗剂的治疗